银汞合金调拌完成以后，需要在多长时间之内完成充填
A. 0.5～1分钟
B. 1～2分钟
C. 2～3分钟
D. 3～4分钟
E. 4～5分钟

正确答案：C。2～3分钟

解析：银汞合金调拌完成后，用小的银汞合金充填器进行充填，充填应在2～3分钟内完成。银汞合金从调制到充填完毕，应该在6-7分钟。掌握“牙体充填材料之银汞合金”知识点。